诊断宫内早孕最可靠的辅助检查方法是
A. 尿妊娠试验
B. 基础体温测定
C. B型超声检查
D. 阴道脱落细胞学检测
E. 宫颈黏液涂片干燥后镜检

正确答案：C。B型超声检查

解析：B超检查（C对）能确定宫内早孕，排除异位妊娠和滋养细胞疾病。尿妊娠试验（A错）是诊断早孕的最敏感方法，于受精后10日即可检测出；基础体温测定（P43）（B错）出现高温相18日提示早孕的可能性大；宫颈黏液涂片干燥后镜检（P42）（E错）可以见到排列成行的珠豆状椭圆体，这种结晶可见于妊娠期，也可见于黄体期；此三项均不能作为早孕独立的诊断依据，更不能确保是宫内早孕。阴道脱落细胞学检查（P23）（D错）可以了解体内雌激素水平和有无排卵，对宫内早孕的的诊断帮助不大。